鉴别肺炎链球菌与甲型链球菌的试验是
A. 胆汁溶菌试验和菊糖发酵试验
B. 胆汁溶菌试验和甘露醇发酵试验
C. 血浆凝固酶试验和甘露醇发酵试验
D. 血浆凝固酶试验和菊糖发酵试验
E. 乳糖发酵试验和蔗糖发酵试验

正确答案：A。胆汁溶菌试验和菊糖发酵试验

解析：对于A群链球菌来说，一般不分解菊糖，不被胆汁溶解；而对于肺炎链球菌来说，利用胆汁可激活肺炎链球菌的自溶酶系统加速菌体自溶，故利用胆汁溶菌试验与菊糖发酵实验可以鉴别肺炎链球菌与甲型链球菌。掌握“链球菌属”知识点。